典型的腹外疝不包括
A. 疝环
B. 疝囊
C. 疝内容物
D. 疝外被盖
E. 疝外壁

正确答案：E。疝外壁

解析：典型的腹外疝由疝环（A对）、疝囊（B对）、疝内容物（C对）和疝外被盖组成（D对）（E错，为本题正确答案）。